患者，男，70岁。发热，咳嗽1周。查体：体温38℃，血压80/50mmHg（10.6/6.7kPa），左肺下可闻及湿啰音。下列哪项处理是错误的：
A. 吸氧
B. 药物降温
C. 补充血容量
D. 纠正酸中毒
E. 使用血管活性药物

正确答案：B。药物降温

解析：本例患者为老年男性，发热、咳嗽一周，查体可见体温38℃（腋测法正常值为36～37℃，体温升高），血压下降，左肺下可闻及湿啰音，故诊断考虑是肺部感染性疾病。吸氧（A对）为该患者的一般治疗措施。补充血容量（C对）、使用血管活性药物（E对）可提高血压。因部分严重肺部感染性疾病常合并酸中毒，故治疗需纠正酸中毒（D对）。药物降温常用于高热患者，此患者为低热，故一般不需要药物降温（B错，为本题正确答案）。